下列哪一作用与阿司匹林引起的反应无关
A. 上腹不适、恶心、呕吐
B. 出血时间延长
C. 荨麻疹
D. 头痛、眩晕、耳鸣、视听力减退
E. 口干、出汗、心悸

正确答案：E。口干、出汗、心悸

解析：本题考查阿司匹林的不良反应。口干、出汗、心悸（E错，为本题的正确答案）可见于哌替啶、吗啡的不良反应。阿司匹林的不良反应包括：1.胃肠道反应：最为常见，口服可直接刺激胃黏膜，引起上腹不适、恶心、呕吐（A对）；2.加重出血倾向：阿司匹林能不可逆抑制COX，对血小板合成TXA₂有强大而持久的抑制作用，使血液不易凝固，出血时间延长（B对）；3.水杨酸反应：阿司匹林剂量过大（5g/d）时，可出现头痛、眩晕、恶心、呕吐、耳鸣、视听力减退（D对），总称为水杨酸反应，是使用水杨酸类药物中毒的表现；4.过敏反应：少数患者可出现荨麻疹（C对）、血管神经性水肿和过敏性休克；5.瑞夷综合征：在儿童感染病毒性疾病如流感、水痘、麻疹、流行性腮腺炎等使用阿司匹林退热时，偶可引起急性肝脂肪变性-脑病综合征（瑞夷综合征），以肝衰竭合并脑病为突出症状表现，虽少见，但预后恶劣；6.对肾脏的影响：阿司匹林对正常肾功能并无明显影响；但在少数人，特别是老年人，伴有心、肝、肾功能损害的患者，即便用药前肾功能正常，也可引起水肿多尿等肾小管功能受损的症状。